行胃高选择性迷走神经切断术时，作为保留分支标志的是其
A. 胃前支
B. 胃后支
C. 肝胆支
D. “鸦爪”支
E. 腹腔支

正确答案：D。“鸦爪”支

解析：胃的运动和分泌主要受交感神经和迷走神经的支配，迷走神经兴奋时，胃的运动和分泌增强。左、右两支迷走神经沿食管右侧下行，左支在贲门腹侧面分出肝胆支和胃前支，右支在贲门背侧分出腹腔支和胃后支。胃、前后支沿小弯下行，并发出分支进入胃壁，终末“鸦爪”支分布至胃窦，控制胃窦的运动和幽门的排空。高选择性迷走神经切断术切断了支配胃近端、胃底、胃体壁细胞的迷走神经，保留了迷走神经前后干、肝支、腹腔支及“鸦爪”支，其中作为保留分支标志的是“鸦爪”支（D对）。